只有在有处方权的专业医师指导下才能安全使用
A. 处方药
B. 非处方药
C. 两者都是
D. 两者都不是

正确答案：A。处方药

解析：本题考查处方药。只有在有处方权的专业医师指导下才能安全使用是处方药（A对）。处方药是指凭执业医师和执业助理医师处方方可购买、调配和使用的药品。非处方药（B错）是指由国家药品监督管理局公布的，不需要凭执业医师和执业助理医师处方，消费者可以自行判断、购买和使用的药品。